感染后病情较轻的痢疾杆菌是
A. 痢疾志贺菌
B. 福氏志贺菌
C. 宋内志贺菌
D. 鲍氏志贺菌
E. 舒氏志贺菌

正确答案：C。宋内志贺菌

解析：福氏志贺菌感染易转为慢性（B错）；宋内志贺菌感染往往症状较轻，多呈不典型发作（C对）；痢疾志贺菌的毒力最强，病情最重（A错）。